糖尿病高渗高血糖综合征常见于
A. Ⅱ型糖尿病合并妊娠
B. 饮食控制不佳的Ⅱ型糖尿病
C. 青少年Ⅱ型糖尿病
D. Ⅰ型糖尿病
E. 老年Ⅱ型糖尿病

正确答案：E。老年Ⅱ型糖尿病

解析：I型糖尿病患者胰岛B细胞受损严重，胰岛素分泌绝对不足，胰岛素绝对缺乏，易并发糖尿病酮症酸中毒（D错）。糖尿病高渗高血糖综合征，以严重高血糖、高血浆渗透压、脱水为特点，主要见于老年II型糖尿病患者（E对BC错）。由于妊娠期复杂的代谢变化，加之高血糖及胰岛素相对或绝对不足，代谢紊乱进一步发展到脂肪分解加速，血清酮体急剧升高，进一步发展为代谢性酸中毒，故Ⅱ型糖尿病合并妊娠易发生糖尿病酮症酸中毒（A错）（妇产科学P76）。